找出不同条件下高发人群、患者以及高发地区的共同特点
A. 求同法
B. 求异法
C. 共变法
D. 排除法
E. 类比法

正确答案：A。求同法